微小病变型肾病多表现为
A. 血尿
B. 肾小球酸中毒
C. 白蛋白尿
D. 白细胞尿
E. 肾性糖尿

正确答案：C。白蛋白尿

解析：原发性肾病综合征表现为不同类型的病理改变，常见的有：①微小病变型肾病；②系膜增生性肾小球肾炎；③局灶节段性肾小硬化；④膜性肾病；⑤系膜毛细血管性肾小球肾炎。微小病变型肾病多表现为大量白蛋白尿（C对），低白蛋白血症，水肿，高血压。血尿（P460）（A错）多见于肾炎综合征和IgA肾病等。白细胞尿（P494）（D错）多见于泌尿系感染。肾性糖尿（P490）（E错）多见于肾间质疾病，肾小管损伤导致近端小管重吸收功能障碍，尿糖含量增高。